男，28岁。在田地劳动时，右足被带锈铁钉刺伤，伤口约2cm，自行包扎未就医。5天后患者出现全身乏力，头晕，头痛，并觉张口困难，颈强直(+），头后仰，角弓反张。对造成该疾病的致病菌特点的描述，正确的是
A. 细菌形态为球菌
B. 致病菌素主要为内毒素
C. 感染必须具有缺氧环境
D. 革兰染色阴性
E. 芽胞对热、干燥不耐受

正确答案：C。感染必须具有缺氧环境

解析：青年男性患者，田间耕作时被带锈铁钉刺伤右足（破伤风梭菌常见感染途径），伤口约2cm，自行包扎未就医（伤口狭小且封闭），5天后患者出现全身乏力，头晕，头痛，并觉张口困难，颈强直（+），头后仰，角弓反张（破伤风梭菌感染特有体症），根据患者感染途径、临床表现和体征该患者的诊断考虑为破伤风，常由破伤风梭菌引起（A错），破伤风梭菌为厌氧菌，感染必须具有缺氧环境（C对）。致病菌素为外毒素，主要是痉挛毒素，内毒素是多种革兰氏阴性菌的细胞壁成分，例如脑膜炎奈瑟菌、伤寒杆菌、细菌性痢疾等（B错）。革兰染色阴性（D错）多见于杆菌，破伤风为格兰阳性梭菌，革兰染色阳性。芽孢的抵抗力强，对热力、干燥、辐射、化学消毒剂等理化因素均有强大的抵抗力（E错），用一般的方法不易将其杀死，实验室常用灭菌法为高压蒸汽灭菌，分为两种方式：120℃，保持20min；115℃，保持30min。